行于下肢内侧后缘的经脉是
A. 足少阴肾经
B. 足厥阴肝经
C. 足阳明胃经
D. 足太阴脾经
E. 足少阳胆经

正确答案：A。足少阴肾经

解析：本题考查十二经脉在四肢的分布，属于理解记忆内容。下肢内侧，内踝尖上八寸以下为厥阴在前，太阴在中，少阴在后；内踝尖上八寸以上则太阴在前，厥阴在中，少阴在后（A对，BCDE错）。